抗排异药环孢素可致的主要用药风险是
A. 心脏毒性（折返心律和传导阻滞）
B. 肺毒性（间质性肺炎）
C. 血液毒性（骨髓造血功能障碍）
D. 耳毒性（耳聋）
E. 肾毒性（血肌酐升高）

正确答案：E。肾毒性（血肌酐升高）

解析：本题考查环孢素的不良反应。环孢素的不良反应常见胃肠道反应，如厌食症、恶心等，具有肾毒性，如血肌酐升高（E对），肾小球滤过降低。另外常见的副作用还包括肝损伤、高血压等。